遗传性乳光牙本质的临床表现如下，除外
A. 仅发生在乳牙列
B. 光照下呈现乳光
C. 牙釉质易剥脱，牙本质暴露
D. 牙冠易咀嚼磨损
E. X线片可见髓室和根管闭锁

正确答案：A。仅发生在乳牙列

解析：遗传性乳光牙本质的临床表现：①受累牙列三种类型疾病的牙齿临床表现差异很大：一般DGI-Ⅰ的乳牙受累较恒牙更严重，而DGI-Ⅱ的乳、恒牙受累程度均等。②患牙表现牙齿颜色从灰到棕紫色或黄棕色，但均伴有罕见的、半透明或乳光色。由于患牙釉牙本质结合缺乏扇贝形排列，导致釉质早期丧失，牙本质遭受快速磨耗，乳、恒磨牙的（牙合）面常常变得极为扁平。但患牙似乎并不比正常牙更易患龋。③X线片表现DGI-Ⅰ和DGI-Ⅱ牙齿在X线片上有异常、特殊的表现。最显著的特点是不断形成的牙本质将髓腔和根管过早地部分或完全的堵塞、闭锁。乳牙和恒牙均可见到这种表现。牙根尽管可能短、钝，但牙骨质、牙周膜和支持骨表现正常。掌握“遗传性牙本质发育不全”知识点。